临床上判断病情好转程度的重要指标是
A. 幻觉消失
B. 妄想消退
C. 情感恢复正常
D. 无行为紊乱
E. 自知力恢复

正确答案：E。自知力恢复